编制简略寿命表时人为假定的同时出生的一代人是指
A. 所有年龄的尚存人数
B. “0～”岁组的平均人口数
C. “0～”岁组生存总人年数
D. “0～”岁组的尚存人数
E. 所有年龄的平均人口数

正确答案：D。“0～”岁组的尚存人数

解析：本题考查简略寿命表中的尚存人数。简略寿命表的尚存人数表示假设的同时出生的一代人（一般假定为10万人，即‘0～’岁组的尚存人数（D对ABCE错）l₀=100000）中，X岁年龄组尚存活的平均人数。